临床用于术后腹气胀与尿潴留效果好的药物是
A. 新斯的明
B. 毒扁豆碱
C. 阿托品
D. 碘解磷定
E. 氯磷定

正确答案：A。新斯的明